甲亢治疗时粒细胞减少多见于
A. 放射性核素¹³¹I治疗
B. 复方碘溶液治疗
C. 抗甲状腺药物治疗
D. 甲状腺次全切除术
E. 甲状腺素治疗

正确答案：C。抗甲状腺药物治疗

解析：粒细胞减少常见于抗甲状腺药物治疗（C对）。放射性核素¹³¹I治疗（A错）、复方碘溶液（B错）、甲状腺次全切除术（D错）常见的不良反应是甲状腺功能减低。甲状腺素治疗（E错）常见的不良反应是甲状腺功能亢进。